以下关于OHI-S的叙述，错误的是
A. 包括DI-S和CI-S
B. OHI-S为简化口腔卫生指数
C. 检查软垢以视诊为主
D. 包括简化软垢指数和简化牙石指数
E. 不可用于个人

正确答案：E。不可用于个人

解析：简化口腔卫生指数（OHI-S）包括简化软垢指数（DI-S）和简化牙石指数（CI-S）。简化口腔卫生指数可以用于个人，但主要用于人群口腔卫生状况评价。掌握“牙周病流行病学及分级预防”知识点。